下列对于健康表述正确的是
A. 生理、心理、社会适应能力完好就是健康
B. 生理功能正常即为健康
C. 健康等于无病，无病即健康
D. 生理、心理状况达到完好状态即健康
E. 心理处于完好状态，心理健康即是健康

正确答案：A。生理、心理、社会适应能力完好就是健康

解析：本题考查健康的概念。WHO提出健康的概念是：健康不仅是没有疾病或虚弱，而是一种身体、心理和社会的完好状态（A对BCDE错）。